深龋的治疗原则中错误的说法是
A. 停止龋病发展
B. 促进牙髓的防御反应
C. 保护牙髓
D. 正确判断牙髓状况
E. 彻底去净腐质

正确答案：E。彻底去净腐质

解析：深龋的治疗原则：停止龋病发展，促进牙髓的防御反应；保护牙髓；正确判断牙髓状况。E项说法不正确。深龋治疗中，若急性龋洞底有近髓的软化牙本质，可适当保留软化牙本质，促进牙髓的修复性反应。掌握“深龋的治疗”知识点。